可能与胺碘酮发生相互作用而致出血风险增高的抗栓药物是
A. 氯吡格雷
B. 阿司匹林
C. 依诺肝素
D. 肝素
E. 达比加群酯

正确答案：E。达比加群酯

解析：本题考查达比加群酯。可能与胺碘酮发生相互作用而致出血风险增高的抗栓药物是达比加群酯（E对）。达比加群酯为直接凝血酶抑制剂，适用于静脉血栓和抗凝治疗，与胺碘酮相互作用，可使达比加群酯血浆浓度提高约50%，增加出血危险。氯吡格雷（A错）用于预防和治疗因血小板高聚集引起的心、脑及其他动脉循环障碍疾病。阿司匹林（B错）是抗血小板药的代表药。依诺肝素（C错）预防深静脉血栓形成及肺栓塞，治疗已形成的静脉血栓，预防血液透析时体外循环中血栓的形成，治疗不稳定性心绞痛和非Q波心梗。肝素（D错）用于防治血栓形成或栓塞性疾病、各种原因引起的弥漫性血管内凝血。